糖浆可作为
A. 崩解剂
B. 黏合剂
C. 两者均可
D. 两者均不可

正确答案：B。黏合剂

解析：本题考查片剂的常用辅料。单糖浆除用作矫味剂外,因具有一定的黏性,可作为黏合剂（B对）、助悬剂、片剂包糖衣材料。糖浆不能用作崩解剂（ACD错）。